难溶性的药物片剂一般应作
A. 重量差异检查
B. 崩解时限检查
C. 含量均匀度检查
D. 溶出度测定
E. 不溶性微粒检查

正确答案：D。溶出度测定